8岁儿童受伤后右手掌着地，右肘部肿胀，肘后三角正常，骨皮质不连续，右手指皮肤苍白发凉，损伤的部位是
A. 正中神经损伤
B. 缺血性肌挛缩
C. 肱动脉损伤
D. 骨筋膜室综合征
E. 桡神经损伤

正确答案：C。肱动脉损伤

解析：8岁儿童受伤后右手掌着地，右肘部肿胀，肘后三角正常，骨皮质不连续，右手指皮肤苍白发凉，结合患者的病史和表现，提示损伤的部位是肱动脉损伤（C对）。正中神经损伤常由儿童肱骨髁上骨折和腕部切割伤引起。腕部损伤时所支配的鱼际肌和蚽状肌麻痹表现为拇指对掌功能障碍和手的桡侧半感觉障碍，特别是示、中指远节感觉消失。而肘上损伤则所支配的前臂肌亦麻痹，除上述表现外，另有拇指和示、中指屈曲功能障碍（A错）。（P701）桡神经在肱骨中段后方至肱骨中、下 1/3 交界处外侧紧贴骨面，该处骨折时容易引起桡神经损伤，表现为伸腕、伸拇、伸指、前臂旋后障碍及手背桡侧（虎口区）感觉异常 典型的畸形是垂腕。若为桡骨头脱位所致的桡神经深支损伤，因桡侧腕长伸肌功能完好，伸腕功能基本正常（桡偏），而仅有伸拇、伸指障碍，无手部感觉障碍(E错)。